硬腭的构成是
A. 由左、右上颌骨的腭突组成
B. 由腭骨的水平部构成
C. 由腭骨的垂直部构成
D. 由上颌骨的腭突和腭骨的水平部组成
E. 由上颌骨的腭突和腭骨的垂直部组成

正确答案：D。由上颌骨的腭突和腭骨的水平部组成

解析：硬腭由骨腭及黏膜构成，骨腭由上颌骨的腭突与腭骨的水平板构成(D对)。